引起支气管哮喘发作，释放细胞因子和炎症介质的细胞是
A. 气道上皮细胞
B. 肥大细胞
C. 嗜酸性粒细胞
D. 肺泡巨噬细胞
E. 以上都包括

正确答案：E。以上都包括

解析：支气管哮喘是由多种细胞如嗜酸粒细胞（C对）、肥大细胞（B对）、T淋巴细胞、中性粒细胞、平滑肌细胞、气道上皮细胞（A对）等和细胞组分参与的气道慢性炎症性疾病，而气道慢性炎症（P29-P30）作为哮喘的基本特征，存在于所有的哮喘患者，表现为气道上皮下肥大细胞、嗜酸粒细胞、巨噬细胞（D对）、淋巴细胞及中性粒细胞等的浸润，以及气道黏膜下组织水肿、微血管通透性增加、支气管平滑肌痉挛、纤毛上皮细胞脱落、杯状细胞增生及气道分泌物增加等病理改变。气道上皮细胞、肥大细胞、嗜酸性粒细胞及肺泡巨噬细胞均可释放细胞因子和炎症介质，它们共同构成了一个相互作用的复杂网络，从而进一步引起支气管哮喘的发作（E对，为本题正确答案）。